某广告说：“某新药治疗1000名上呼吸道感染，其中950名在5天内症状消失，从而认为，这种新药治疗上呼吸道感染有奇效”，此结论
A. 正确
B. 不正确，因为没有计算治愈率
C. 不正确，因为没有设立对照组
D. 不正确，因为没有做统计学检验
E. 不正确，因为样本含量不够大

正确答案：C。不正确，因为没有设立对照组